3位甲基上具有巯基杂环取代的头孢类药物
A. 头孢克洛
B. 头孢哌酮钠
C. 头孢羟氨苄
D. 头孢噻吩钠
E. 头孢噻肟钠

正确答案：B。头孢哌酮钠

解析：本题考查头孢菌素类抗菌药。头孢哌酮钠（B对）C-3位甲基上引入硫代甲基四氮唑杂环取代乙酰氧基。头孢克洛（A错）的C-3位取代为氯原子；头孢羟氨苄（C错）的C-3取代为甲基；头孢噻吩钠（D错）与头孢噻肟钠（E错）C-3位取代均为乙酰氧甲基。